男，46岁。消瘦、乏力、头晕、食欲减退3年，近5个月早晨有时出现精神症状，进食后缓解。查体：BP80/60mmHg，皮肤色素沉着，心率60次/分，血糖2.7mmol/L，血钠124mmol/L，血钾5.2mmol/L。最可能的病因是
A. 原发性慢性肾上腺皮质功能减退症
B. 胰岛素瘤
C. 营养不良
D. 2型糖尿病
E. 自主神经功能紊乱

正确答案：A。原发性慢性肾上腺皮质功能减退症

解析：中年男性患者，消瘦、乏力、头晕、食欲减退，近5个月早晨有时出现精神症状，进食后缓解（怀疑为低血糖症状）。查体血压降低、全身皮肤色素沉着（原发性慢性肾上腺功能减退症的特征性表现），低血糖（正常值为3.9～6.0mmol/L）、低血钠（正常值为135～145mmol/L）、血钾正常高值（正常值为3.5～5.5mmol/L）。以上均符合慢性肾上腺皮质功能减退症（A对）。胰岛素瘤（B错）典型表现为Whipple三联征，即禁食后低血糖发作，发作时血糖＜2.8mmol/L，给予葡萄糖后症状立即消失，但不会有色素沉着等症状。2型糖尿病（D错）表现为三多一少，血糖升高。营养不良（C错）自主神经功能紊乱（E错）皮肤色素沉着少见。